阳虚证最主要的表现是
A. 舌质淡白苔薄白
B. 口不渴或少饮
C. 面色白而无华
D. 脉沉细无力
E. 经常畏寒肢凉

正确答案：E。经常畏寒肢凉

解析：由于阳气亏虚，机体失却温煦，不能抵御阴寒之气，而寒从内生，于是出现畏冷肢凉等一派病性属虚、属寒的证候，故阳虚证最主要的表现是经常畏寒肢凉（E对）。舌质淡白苔薄白不仅见于阳虚证，也可见于气血两虚证，故选项A不是阳虚证的最主要表现（A错）。阳虚水湿不化，则口淡不渴或少饮。但是阳虚不能温化和蒸腾津液上承，则可见渴喜热饮。阳虚证中既可以出现口不渴或少饮也可以出现渴喜热饮，故选项B不是阳虚证的最主要表现（B错）。面色白而无华多由气虚血少或阳衰，气血不能上充于面部所致，故选项C不仅见于阳虚证（C错）。脉沉细无力多由气血俱虚、湿证所致，阳虚证既可以出现脉沉细无力，也可以出现脉沉迟无力。故选项D不是阳虚证最主要的表现（D错）。